患者，男，8岁，静脉滴注美洛西林后立即出现胸闷气短、呼吸困难，喉头水肿，考虑为青霉素类抗生素的过敏反应，按照其发生机制，该患者发生的过敏反应在分型上属于
A. Ⅱ型变态反应
B. I型变态反应
C. Ⅲ型变态反应
D. Ⅳ型变态反应
E. V型变态反应

正确答案：B。I型变态反应

解析：本题考查过敏反应的分型。青霉素类抗生素的过敏反应在分型上属于I型变态反应（B对）。青霉素类用药后可发生严重的过敏反应，如过敏性休克（I型变态反应）、溶血性贫血（Ⅱ型变态反应）（A错）、血清病型反应（Ⅲ型变态反应）（C错）、接触性皮炎（Ⅳ型变态反应）（D错）、白细胞计数减少、药疹、荨麻疹、接触性皮炎、哮喘发作等。过敏反应没有V型变态反应（E错）。